下列哪项不是反映疾病严重程度的指标
A. 两周卧床率
B. 两周患病率
C. 两周患病天数
D. 两周休学率

正确答案：B。两周患病率

解析：本题考查反映疾病严重程度的指标。反映疾病严重程度的指标有：两周卧床率（A对）；两周活动受限率；两周休工（学）率（D对）；两周患病天数（C对）等。两周患病率（B错，为本题正确答案）是反映疾病频率（度）的指标。